男性，35岁。舌部破溃疼痛1周。10天前曾患“感冒、发热”并伴有口腔多处糜烂。口腔检查：舌背中央可见直径2cm的糜烂面，充血、水肿明显，表面有黄褐色假膜，较易拭去，遗留渗血糜烂面，疼痛明显，有非特异性口臭。拟诊
A. 口腔扁平苔癣
B. 急性假膜型念珠菌口炎
C. 复发性疱疹性口炎
D. 复发性重型阿弗他溃疡
E. 球菌性口炎

正确答案：E。球菌性口炎

解析：本题考查球菌性口炎的临床表现。男性，35岁。舌部破溃疼痛1周。10天前曾患“感冒、发热”并伴有口腔多处糜烂。口腔检查：舌背中央可见直径2cm的糜烂面，充血、水肿明显，表面有黄褐色假膜，较易拭去，遗留渗血糜烂面，疼痛明显，有非特异性口臭。拟诊球菌性口炎（E对）。球菌性口炎多发生于体弱和抵抗力低下的患者，有些患者可伴有发热等全身症状。典型病损特征有灰黄色假膜，拭去假膜见溢血糜烂面，有炎症口臭，体温升高等，患者的临床表现符合球菌性口炎的病变特点。口腔扁平苔癣（A错）病损表现为小丘疹连成的线状白色、灰白色花纹，也可表现为白色斑块状，患者自觉黏膜粗糙、木涩感、烧灼感。急性假膜型念珠菌口炎（B错）以新生儿最多见，损害区黏膜充血，有散在的色白如雪的柔软小斑点，如针帽头大小，不久即相互融合为白色或蓝白色丝绒状斑片，斑片附着并不十分紧密，稍用力可擦掉，暴露红的黏膜糜烂面及轻度出血。复发性疱疹性口炎（C错）的损害特点表现为有成簇的小水疱，疱破后成为大片表浅溃疡，损害易在原先发作过的位置或邻近原先发作过的位置复发。复发性重型阿弗他溃疡（D错）的溃疡大而深，似弹坑，直径可大于10mm，周围组织红肿微隆起，表面有灰黄色假膜或灰白色坏死组织，溃疡期持续时间较长，有反复发作史。